食物成分表上的营养素含量均指
A. 食物整体的含量
B. 食物可食部分的含量
C. 食物去皮部分的含量
D. 食物可烹调部分的含量
E. 食物加工部分的含量

正确答案：B。食物可食部分的含量

解析：本题考查食物成分表上的营养素含量。食物成分表上的营养素含量均指可食部分的含量（B对ACDE错）。